以下关于带状疱疹描述正确的是
A. 由水痘-带状疱疹病毒（HIV）所引起
B. 侵犯儿童可引起带状疱疹
C. 以弥散性小水疱为特征
D. 以沿双侧周围神经分布
E. 通常伴有明显的神经痛

正确答案：E。通常伴有明显的神经痛

解析：本题考查带状疱疹。带状疱疹是由水痘-带状疱疹病毒（VZV）所引起的（A错），以沿单侧周围神经分布（D错）的簇集性小水疱为特征（C错），常伴有明显的神经痛（E对）。水痘-带状疱疹病毒为本病的致病病原体，侵犯儿童可引起水痘（B错），在成年人及老年人则引起带状疱疹。